肾结石患者禁用的药物是
A. 非布索坦
B. 苯溴马隆
C. 秋水仙碱
D. 别嘌醇
E. 碳酸氢钠

正确答案：B。苯溴马隆

解析：本题考查药物的禁忌症。苯溴马隆（B对）对痛风性关节炎急性发作期，有中、重度肾功能不全或肾结石者禁用。非布索坦（A错）的不良反应大多轻微，具有自限性，常见的有腹泻、背痛、头痛和关节痛，其在轻、中度的肝肾损伤的测试组中的AUC并未显著改变，因此对肝肾衰竭患者也没有影响。秋水仙碱（C错）：骨髓增生低下及肝肾功能中重度不全者禁用。别嘌醇（D错）：肝肾功能不全者、老年人应慎用，并减少日用量，且无症状的高尿酸血症者不宜服用。碳酸氢钠（E错）：有溃疡出血者、限制钠盐摄入者禁用。